与靶细胞CD4分子结合的微生物是
A. 朊粒
B. 曲霉菌
C. 肺炎衣原体
D. 普氏立克次体
E. 人类免疫缺陷病毒

正确答案：E。人类免疫缺陷病毒

解析：与靶细胞CD4分子结合的微生物是人类免疫缺陷病毒（E对）。